屈光不正的预防原则是
A. 培养儿童注意阅读、书写卫生
B. 注意户外活动
C. 坚持做眼保健操
D. 改善学习环境
E. 以上都是

正确答案：E。以上都是

解析：本题考查屈光不正的预防原则。屈光不正是指当眼球调节松弛状态下，来自5m以外的平行光线，经过眼的屈光系统屈折后，不能在视网膜上清晰成像者。它包括远视、近视及散光。屈光不正的预防原则：（1）培养儿童平时阅读或书写卫生；（2）改善学习环境，光线要充足、柔和；（3）注意用眼距离，坚持做眼保健操；（4）注意户外活动，防止眼肌疲劳（E对ABCD错）。